5%葡萄糖注射液500ml含有葡萄糖的克数是
A. 25
B. 30
C. 10
D. 33.3
E. 20

正确答案：A。25

解析：本题考查百分浓度的计算。重量比体积百分浓度=溶质重量/溶液体积×100%。由题可知：重量比体积百分浓度=5%；溶液体积=500ml。所以代入上式可得：5%=溶质质量/500×100%，溶质质量=25g（A对）。